复合树脂充填材料的粘接修复体脱落的原因，除了
A. 牙齿表面未彻底清洁
B. 酸蚀后的牙面接触唾液
C. 复合树脂充填物较薄
D. 牙齿表面未干燥
E. 制备了固位形

正确答案：E。制备了固位形

解析：本题考查复合树脂充填材料的粘接修复体脱落的原因。制备固位形，可增强充填体的固位力，防止修复体脱落（E错，为本题的正确答案）。牙齿表面未彻底清洁（A对）、酸蚀后的牙面接触唾液（B对）、牙齿表面未干燥（D对）均影响粘结剂的粘接效果，造成粘接不牢，其修复体脱落。复合树脂充填物较薄则充填物在受力时易折断脱落（C对）。